杀灭包括芽胞在内所有微生物的方法称为
A. 消毒
B. 无菌
C. 防腐
D. 灭菌
E. 抑菌

正确答案：D。灭菌

解析：灭菌（D对）是杀灭物体上所有微生物的方法，包括杀灭细菌芽胞、病毒和真菌等在内的全部病原微生物和非病原微生物。消毒（A错）是杀死物体上或环境中的病原微生物并不一定能杀死细菌芽胞或非病原微生物的方法（P32）。防腐（C错）是防止或抑制微生物生长繁殖的方法，细菌一般不死亡（P32）。无菌（B错）是不存在活菌的意思，多是灭菌的结果（P33）。抑菌（E错）是抑制细菌和真菌的生长繁殖的方法，常用的抑菌剂是一些抗生素。